不属于卫生服务需要指标的是
A. 两周每千人患病人数
B. 两周患病率
C. 两周每千人患病日数
D. 每千人因病卧床天数
E. 一年内每千人住院日数

正确答案：E。一年内每千人住院日数